分子中含手性中心，左旋体活性大于右旋体的药物是
A. 磺胺甲噁唑
B. 诺氟沙星
C. 环丙沙星
D. 氧氟沙星
E. 吡嗪酰胺

正确答案：D。氧氟沙星

解析：本题考查氧氟沙星。氧氟沙星（D对）含有手性碳原子，左旋体抗菌活性大于右旋体，故以左旋体为临床使用。磺胺甲噁唑（A错）、诺氟沙星（B错）、环丙沙星（C错）、吡嗪酰胺（E错）均无手性中心。